由于下颌骨位置的变化，可产生不同的颌位，其中有重复性、又有临床意义的颌位是
A. 最大前伸颌位
B. 前伸（牙合）颌位
C. 侧（牙合）颌位
D. 对刃颌位
E. 牙尖交错位

正确答案：E。牙尖交错位

解析：由于下颌骨位置的变化，可产生不同的颌位，其中有重复性、又有临床意义的有三种颌位（牙尖交错位、后退接触位、下颌姿势位）和正中关系。掌握“牙尖交错位、后退接触位与正中关系”知识点。